关于肝素，哪项错误
A. 肝素过量能引起骨质疏松
B. 肝素不能口服
C. 肝素是通过抗凝血酶Ⅲ起作用
D. 肝素用量越大，其抗凝活性t½越长
E. 肝素只在体外有抗凝血作用

正确答案：E。肝素只在体外有抗凝血作用